围术期糖尿病患者宜选用
A. 胰岛素
B. 二甲双胍
C. 格列喹酮
D. 瑞格列奈
E. 阿卡波糖

正确答案：A。胰岛素

解析：本题考查糖尿病的治疗。对有手术，妊娠和哺乳期妇女，严重创伤者可短期采用胰岛素（A对）治疗。